测量人群中某隐性感染为主的疾病时，所用指标为
A. 发病率
B. 罹患率
C. 感染率
D. 续发率

正确答案：C。感染率

解析：本题考查隐性感染测定指标。当测量人群中隐性感染为主的疾病时应优先选用感染率（C对ABD错）这一指标。感染率在对隐性感染、病原携带者及轻型和不典型病例的调查较为常用。